小儿易患解颅五迟五软，主要是
A. 肾常虚
B. 阴常不足
C. 肺常不足
D. 脾常不足
E. 心常有余

正确答案：A。肾常虚

解析：小儿肾常虚。精髓未充。骨气未成，先天肾气虚弱，若后天失于调养，影响小儿生长发育，易患五迟、五软、鸡胸、龟背等（A对）。小儿的生理特点为“阳常有余”而“阴常不足”，若各种原因导致肾的阴阳失调，肾阴不足，不能制阳，阴虚火旺则性征提前，天癸早至，发为早熟（B错）。小儿肺常不足，肌肤疏薄，腠理不密，加之寒暖不知自调、护理失当，外邪易从口鼻而入，以致肺气失宣，发生感冒、咳嗽、肺炎喘嗽等肺系病证（C错）。小儿脾常不足，运化力弱，由于生长发育的需要、力求多摄取营养以供其所需，胃肠负担相对较重，加之小儿乳食不知自节，若稍有调护不当，内伤饮食，易发生呕吐、泄泻、积滞、疳证等脾胃系病证（D错）。小儿脏腑娇嫩，心神怯弱，肝气未盛，感邪之后，邪气易于枭张，从阳化热，由温及火，因而易见火热伤心生惊，伤肝引动肝风的证候。即所谓“心常有余”“肝常有余”（E错）。